强力枇杷露注意事项事项有
A. 年老体弱者慎用
B. 外感咳嗽者忌用
C. 高血压及心脏病忌用
D. 不得过量久服
E. 痰浊壅盛者忌用

正确答案：B、D、E。外感咳嗽者忌用；不得过量久服；痰浊壅盛者忌用

解析：本题考查的是强力枇杷露的注意事项。强力枇杷露注意事项事项有外感咳嗽者忌用（B对）、不得过量久服（D对）与痰浊壅盛者忌用（E对）。强力枇杷露：【注意事项】因其含有毒的罂粟壳，故不可过量服用或久用。孕妇、哺乳期妇女及儿童慎用强力枇杷露，禁用强力枇杷胶囊。外感咳嗽及痰浊壅盛者慎用。服药期间，忌食辛辣厚味食物。降气定喘丸：【注意事项】孕妇禁用。虚喘、年老体弱者慎用。因其含麻黄，故高血压病患者、心脏病患者、青光眼患者慎用（AC错）。服药期间，忌食辛辣、生冷、油腻食物。